中年期心理变化的大体趋势是
A. 生理功能有所衰退
B. 智力发展下降
C. 情绪情感波动较大
D. 个性变化方面变化明显
E. 以上都是

正确答案：A。生理功能有所衰退

解析：进入中年期以后，人的各个系统、器官和组织的生理功能便逐渐从完全成熟走向衰退。从中年开始，个体的生理功能有所衰退。由于组织器官功能开始衰退，罹患各种疾病的可能性也日益增长。掌握“不同年龄阶段心理卫生”知识点。